女，51岁。右腹股沟正中包块3年。平卧后可变小，4小时前搬重物后，包块突然增大，并出现胀痛，逐渐加重。1小时前出现右下腹阵发性绞痛。查体：表情痛苦，肠鸣音亢进，可闻及气过水声。右腹股沟下方可及3cm×3cm包块，触痛明显，无搏动感，平卧手法还纳未成功。如行外科治疗，传统术式中最常用的是
A. Shouldice法
B. Ferguson法
C. Halsted法
D. McVay法
E. Bassini法

正确答案：D。McVay法

解析：中年女性，右腹股沟正中包块3年，平卧后可变小（股疝典型表现，因脂肪堆积疝块在平卧时不能完全消失），搬重物后包块增大，出现胀痛，逐渐加重（腹压增加致使股疝发生嵌顿），查体：表情痛苦，肠鸣音亢进，可闻及气过水声，右腹股沟下方可及3cm×3cm包块，触痛明显，无搏动感，平卧手法还纳未成功（腹外疝嵌顿典型表现），根据患者的病史、临床表面体征，最可能的诊断是股疝，已发展为嵌顿性股疝，如不及时处理，会迅速发展为绞窄性疝，目前最常用的手术是Mc Vay修补法（D对），不仅能加强腹股沟管后壁而用于修补腹股沟疝，同时还能堵住股环而用于修补股疝，也可采用无张力加修补法或经腹腔镜加修补术。Shouldice法（A错）、Ferguson法（B错）、Halsted法（C错）、Bassini法（E错）均为腹股沟疝的修补术式。